男性，30岁。腹泻3～5次/日，便稀时带黏液及血，2年来时重时轻近3个月来低热，腹泻，8～10次/日，时有便血，左下腹有压痛，曾用磷霉素钙治疗无效应首先考虑的诊断是
A. 结肠癌
B. 细菌性痢疾
C. 肠结核
D. 小肠吸收不良综合征
E. 溃疡性结肠炎

正确答案：E。溃疡性结肠炎

解析：患者为中年男性，出现腹泻3～5次每日，有黏液脓血便，符合溃疡性结肠炎的临床表现（E对）。结肠癌的临床表现包括排便习惯与粪便性状改变可表现为腹泻与糊状大便，或腹泻与便秘交替，粪质无明显黏液脓血（A错）、腹痛、腹部肿块和全身表现等。